HEV的传播与流行主要是通过
A. 血液和血液制品
B. 性接触
C. 日常生活接触
D. 经粪-口途径传播
E. 垂直传播

正确答案：D。经粪-口途径传播

解析：戊型肝炎潜伏期平均40日（2～9周），其传播途径（主要经粪-口途径传播）和临床表现（隐性感染及急性肝炎，不致慢性肝炎等）与甲型肝炎相似。掌握“丙型、丁型、戊型肝炎病毒”知识点。